龋病常用的诊断方法除外
A. 视诊
B. 菌斑染色
C. 探诊
D. 温度试验
E. X线检查

正确答案：B。菌斑染色

解析：菌斑染色不是龋病常用的诊断方法。龋病常用的诊断方法：①问诊；②视诊；③探诊；④温度刺激试验；⑤X线检查。掌握“龋病的诊断及鉴别诊断”知识点。